肉芽组织的成分不包括
A. 血管内皮细胞
B. 成纤维细胞
C. 平滑肌细胞
D. 炎症细胞
E. 肌成纤维细胞

正确答案：C。平滑肌细胞

解析：肉芽组织的成分有血管内皮细胞（新生毛细血管）（A对）、成纤维细胞（B对）、炎症细胞（D对）及肌纤维母细胞（肌成纤维细胞）（E对）。平滑肌细胞（C错，为本题正确答案）为人体内的组织细胞，主要存在于除心肌之外的大部分内脏肌中，不是肉芽组织的成分。